医务人员将不符合国家规定标准的血液用于患者，给患者健康造成损害的应当
A. 依法赔偿
B. 并予以警告
C. 进行通报批评
D. 责令限期改正
E. 追究刑事责任

正确答案：A。依法赔偿

解析：医疗机构的医务人员违反规定，将不符合国家规定标准的血液用于患者的，由县级以上地方人民政府卫生行政部门责令改正；给患者健康造成损害的，应当依法赔偿，对直接负责的主管人员和其他直接责任人员，依法给予行政处分；构成犯罪的，依法追究刑事责任。掌握“医疗机构临床用血管理、及法律责任”知识点。